临床试验按照时间层面来说，属于
A. 前瞻性研究
B. 验证性研究
C. 随时间进行研究
D. 回顾性研究
E. 渐进性研究

正确答案：A。前瞻性研究

解析：临床试验还是一种特殊的前瞻性研究，它被人为地给予了干预，包括分组以及干预措施。掌握“口腔临床试验方法”知识点。